葛根芩连汤中配伍黄芩的意义
A. 清泄肺热
B. 清热燥湿，厚肠止利
C. 清热泻火
D. 和解清热，以除少阳之邪
E. 清泄胆热

正确答案：B。清热燥湿，厚肠止利

解析：葛根芩连汤方含葛根、甘草、黄芩、黄连四味药，其中葛根辛甘而凉，入脾胃经，既能解表退热，又能升脾胃清阳之气而治下利，为君药。黄连、黄芩清热燥湿、厚肠止利，为臣药（B对）；甘草甘缓和中，调和诸药，为佐使药。